既能养心安神，又能润肠通便的药物是
A. 苦杏仁
B. 柏子仁
C. 酸枣仁
D. 桃仁
E. 川贝母

正确答案：B。柏子仁

解析：柏子仁的功效是养心安神，润肠通便（B对）。苦杏仁的功效是止咳平喘，润肠通便（A错）。酸枣仁的功效是养心益肝，安神，敛汗，生津（C错）。桃仁的功效是活血祛瘀，润肠通便，止咳平喘（D错）。川贝母的功效是清热化痰，润肺止咳，散结消肿（E错）。